在大骨节病人群筛查中，必需拍摄X线片的部位
A. 右手（包括腕关节）
B. 左手（包括腕关节）
C. 左脚（包括踝关节）
D. 右脚（包括踝关节）
E. 右腿膝骨节

正确答案：A。右手（包括腕关节）

解析：本题考查在大骨节病人群筛查中，必需拍摄X线片的部位。在大骨节病人群筛查中，凡生活在大骨节病区的儿童，从断奶时起每年进行一次右手（包括腕关节在内）（A对BCDE错）的X线拍片，一旦发现手指间关节干骺端或骨端异常，即可按大骨节病治疗。少数儿童右手部X线光可能无异常，但主诉有关节疼痛，检查时发现关节运动不灵活、手指向掌侧弯曲或手指末节向掌侧下垂，也应按大骨节病处理。